关于支原体的性状，哪项错误
A. 呈多形态性，培养形成“油煎蛋样”菌落
B. 是能在无生命培养基中生长繁殖的最小微生物
C. 对青霉素敏感
D. 培养支原体的pH不低于7.0
E. 没有细胞壁

正确答案：C。对青霉素敏感